某男，43岁。有慢性支气管炎病史，7日前因患感冒，现症状加重，咳嗽气粗，胸部胀痛，痰黏稠色黄，胸中烦闷，身热，有汗，口渴喜冷饮。咽干，面红，尿赤，便秘，舌红，苔黄腻，脉滑数。宜选用的中成药是
A. 小青龙合剂
B. 养阴清肺丸
C. 清肺化痰丸
D. 补金片
E. 百合固金丸

正确答案：C。清肺化痰丸

解析：本题考查的是咳嗽的辨证论治。有慢性支气管炎病史，7日前因患感冒，现症状加重，咳嗽气粗，胸部胀痛，痰黏稠色黄，胸中烦闷，身热，有汗，口渴喜冷饮。咽干，面红，尿赤，便秘，舌红，苔黄腻，脉滑数。宜选用的中成药是清肺化痰丸（C对）。咳嗽是指肺失宣降，肺气上逆作声，或伴咳吐痰液，为肺系疾病的主要表现之一。西医学中急慢性支气管炎、部分支气管扩张症、慢性咽炎、咳嗽变异性哮喘等以咳嗽为主要表现时，可参考此内容辨证论治。（一）风寒袭肺证：【症状】咳嗽声重，气急，咽痒，咳痰稀薄色白，常伴鼻塞，流清涕，头痛，肢体酸楚，或见恶寒、发热、无汗等风寒表证。舌苔薄白，脉浮或浮紧。【中成药应用】常用中成药有通宣理肺丸、风寒咳嗽丸、杏苏止咳糖浆、三拗片。（二）风热犯肺证：【症状】咳嗽频剧，气粗，或咳声嗄哑，咳痰不爽，痰黏稠或稠黄，喉燥咽痛，口渴，鼻流黄涕，头痛，肢楚，恶风身热。舌边尖红，苔薄黄，脉浮数。【中成药应用】常用中成药有桑菊感冒片、急支糖浆、羚羊清肺颗粒、风热咳嗽胶囊。（三）风燥伤肺证：【症状】干咳，连声作呛，咽痒，咽喉干痛，唇鼻干燥，口干，无痰或痰少而黏，不易咳出，或痰中带血丝，初起或伴鼻塞、头痛、微寒、身热。舌质红而少津，苔薄白或薄黄，脉浮数。【中成药应用】常用中成药有蜜炼川贝枇杷膏、二母宁嗽丸、雪梨止咳糖浆。（四）痰湿蕴肺证：【症状】咳嗽反复发作，咳声重浊，痰黏腻，或稠厚成块，痰多易咳，早晨或食后咳甚痰多，进甘甜油腻物加重，胸闷脘痞，呕恶，食少，体倦，大便时溏。舌苔白腻，脉滑。【中成药应用】常用中成药有二陈丸、橘贝半夏颗粒、蛇胆陈皮胶囊。（五）痰热郁肺证：【症状】咳嗽，气息粗促，或喉中有痰声，痰多，质黏稠色黄，或有腥味，难咳，胸胁胀满，或咳时引痛，面赤，或有身热，口干而黏，欲饮水。舌红，苔黄腻，脉滑数。【中成药应用】常用中成药有清肺化痰丸、清肺抑火丸、复方鲜竹沥液。（六）肺阴亏耗证：【症状】咳嗽日久，干咳少痰，或痰中带血，午后咳甚，或伴五心烦热，颧红，耳鸣，消瘦，神疲。舌质红，苔少，脉细数。【中成药应用】常用中成药有养阴清肺膏（B错）、百合固金丸（E错）、二冬膏。小青龙胶囊（A错）为喘证风寒闭肺证的中成药应用。喘证风寒闭肺证：【症状】喘咳气逆，呼吸急促，胸部胀闷，痰多色白稀薄而带泡沫，兼头痛鼻塞、无汗、恶寒、发热，舌苔薄白而滑，脉浮紧。【中成药应用】常用中成药有小青龙胶囊、风寒咳嗽颗粒、苓桂咳喘宁胶囊、桂龙咳喘宁胶囊。补金片（D错）为喘证肾不纳气证的中成药应用。喘证肾不纳气证：【症状】喘促日久，动则喘甚，呼多吸少，气不得续，小便常因咳甚而失禁，或尿后余沥，形瘦神疲，汗出肢冷，面唇青紫，或有跗肿，舌淡苔薄，脉沉弱；或见喘咳，面红烦躁，口咽干燥，足冷，汗出如油。舌红少津，脉细数。【中成药应用】常用中成药有补金片。